阿托伐他汀钙的日剂量范围是
A. 10～80mg
B. 5～20mg
C. 10～20mg
D. 40～200mg
E. 10～100mg

正确答案：A。10～80mg

解析：本题考查他汀类药物日剂量范围。阿托伐他汀钙的日剂量范围是10～80mg（A对）。他汀类药物主要制剂和日剂量范围为：洛伐他汀10～80mg，阿托伐他汀10～80mg，辛伐他汀5～40mg，普伐他汀10～40mg，氟伐他汀10～40mg，瑞舒伐他汀10～20mg（C错）。